中毒型菌痢的好发年龄是
A. 中青年人
B. 老年人
C. 新生儿
D. 婴幼儿
E. 22002U1-7岁儿童

正确答案：E。22002U1-7岁儿童

解析：中毒型菌痢以2～7岁儿童多见（E对）。病毒感染性腹泻B组轮状病毒主要感染青壮年（A错）。中东呼吸综合征发病人群以中老年为主（B错）。病毒感染性腹泻A组轮状病毒主要感染婴幼儿（D错）。